女，3岁，被牵拉前臂后，出现肘部疼痛，不愿用手取物，桡骨近端压痛。X线片检查未见骨折征象。最适宜的治疗方法是
A. 手法复位
B. 外敷药物
C. 切开探查
D. 石膏固定
E. 肩部固定带悬吊

正确答案：A。手法复位

解析：儿童患者，有被动牵拉史，出现肘部疼痛，X线片检查未发现骨折征象，符合桡骨头半脱位的诊断，其最适宜的治疗方法是手法复位（A对）。外敷药物（B错）适用于开放性骨折的清创术。切开探查（C错）适用于肌腱、神经、血管等重要组织创伤，关节内骨折，多处骨折等。石膏固定（D错）适用于骨折。肩部固定带悬吊（E错）适用于肩关节脱位。